“晨僵”是下列哪个病证的特征性表现
A. 风寒湿痹
B. 风湿热痹
C. 尪痹
D. 卒中后遗症
E. 蝶疮流注

正确答案：C。尪痹

解析：“晨僵”是晨起后病变关节感觉僵硬，日间静止不动也可出现，持续时间至少1小时者意义较大，晨僵为类风湿性关节炎的典型症状，中医称类风湿性关节炎为尪痹（C对ABDE错）。